一患者，腹泻与呕吐均剧烈，不伴腹痛与里急后重，粪便呈白色水样，应考虑的疾病是
A. 急性胃肠炎
B. 急性细菌性痢疾
C. 伤寒
D. 变态反应性肠病
E. 霍乱

正确答案：E。霍乱

解析：霍乱弧菌肠毒素引起的大量水样腹泻属于典型的分泌性腹泻，其产生的机制为霍乱弧菌肠毒素激活肠黏膜细胞内的腺苷酸环化酶，促使环磷酸腺苷含量增加，使水与电解质分泌到肠腔增多，从而导致腹泻，粪便呈白色水样（E对）；急性胃肠炎为动力性腹泻，为水样便（A错）；急性细菌性痢疾为渗出性腹泻，为粘液脓血便（B错）；伤寒患者，大多呈现便秘的消化道症状，仅有10%左右的人排水样便（C错）；变态反应性肠病不会出现白色水样粪便（D错）。